男性，47岁，发热伴胸部持续性疼痛3天，胸骨左缘第三、四肋间收缩期和舒张期均可听到粗糙呈搔抓样声音。为了进一步确定病情，应首选
A. X线胸片
B. 超声心动图
C. 心电图
D. 心功能测定
E. 心导管检查

正确答案：B。超声心动图